五加皮的主治病证不包括
A. 水肿
B. 风湿热痹
C. 腰膝软弱
D. 小儿行迟
E. 脚气浮肿

正确答案：B。风湿热痹

解析：本题考查五加皮的主治病证。五加皮的主治病证不包括风湿热痹（B错，为本题正确答案）。五加皮【主治病证】（1）风湿痹痛，四肢拘挛。（2）肝肾不足所致的腰膝软弱（C对）、小儿行迟（D错）。（3）水肿（A对），脚气浮肿（E错）。